下面是环境污染产生的急性危害，除外
A. 地方性氟中毒
B. 印度博帕尔发生的异氰酸甲酯泄漏事件
C. 前苏联发生过的核电站核泄漏事故
D. 伦敦烟雾事件
E. 介水传染病暴发流行

正确答案：A。地方性氟中毒

解析：本题考查环境污染产生的急性危害。地方性氟中毒（A错，为本题正确答案）是由于一定地区的环境中氟元素过多，而致生活在该环境中的居民经饮水、食物和空气等途径长期摄入过量氟引起的以氟骨症和氟斑牙为主要特征的一种慢性全身性疾病。急性危害是指环境污染物在短时间内大量进入环境，使暴露人群在较短时间内出现不良反应、急性中毒甚至死亡。环境污染急性危害的产生主要包括下列类型：1.大气污染的烟雾事件：如在英国多次发生的伦敦烟雾事件（D对），美国的洛杉矶、纽约和日本大阪、东京发生的光化学烟雾事件，日本的四日市哮喘事件等。2.事故性排放的环境污染事件：如1984年印度博帕尔农药厂发生的异氰酸甲酯泄漏事件（B对）。3.核泄漏事故：从20世纪70年代以来在前苏联、美国、日本都先后发生过核电站核泄漏事故（C对），给周围的居民带来了深重的灾难。4.环境生物性污染引起的急性传染病：饮用水受到病原微生物污染，将可能致饮用者发生急性传染性疾病，如介水传染病暴发流行（E对）。